肿瘤细胞分化程度与治疗有一定关系，细胞分化程度较好的肿瘤，多采用的治疗方法是
A. 手术治疗
B. 放射治疗
C. 化学药物治疗
D. 观察暂不予处理
E. 热疗

正确答案：A。手术治疗

解析：细胞分化程度：肿瘤细胞分化程度与治疗有一定关系。细胞分化程度较好的肿瘤：对放射线不敏感，故常采用手术治疗；细胞分化程度较差或未分化的肿瘤对放射线较敏感，应采用放射与化学药物治疗。当肿瘤处于迅速发展阶段，肿瘤广泛浸润时，手术前应考虑先进行术前放射或化学药物治疗。掌握“口腔颌面部肿瘤的治疗原则及预防”知识点。